《黄帝内经》提出的“天人合一”“形神合一”的心理学观点属于医学心理学发展的哪一阶段
A. 神灵医学心理学时代
B. 哲学医学心理学时代
C. 科学医学心理学时代
D. 现代医学心理学时代
E. 以上都不是

正确答案：B。哲学医学心理学时代